男性，74岁，体重60Kg，全胃切除术后5天，大量肠液自腹腔引流管引出，左上腹疼痛，查体，左上腹轻压痛，无肌紧张。首选的治疗措施是
A. 急症手术
B. 肠外营养
C. 要素饮食
D. 普通饮食
E. 输血

正确答案：B。肠外营养

解析：患者为老年男性，全胃切除术后5天，无法从正常消化道进食，因此需要肠外营养（B对）来维持患者所需能量。普通饮食（D错）和要素饮食（C错）均为肠内营养，会刺激肠道，不利于伤口恢复。急症手术（A错）主要用于吻合口瘘、腹腔内大量出血等危重情况。患者无休克、贫血症状体征，无需输血（E错）。